抑制0相去极化，减慢传导的抗心律失常药是
A. 普萘洛尔
B. 胺碘酮
C. 奎尼丁
D. 苯妥英钠
E. 维拉帕米

正确答案：C。奎尼丁

解析：本题考查奎尼丁的作用机制。奎尼丁（C对）主要通过抑制Na离子的跨膜运动，抑制0相去极化，减慢传导，延长有效不应期，减低兴奋性，从而减慢心房率，临床上主要用于心房颤动或心房扑动经电转复后的维持治疗。